确定胎儿安危最简便而准确的方法是
A. 催产素激惹试验
B. 胎动计数
C. 尿雌三醇测定
D. 胎儿电子监护
E. 羊膜镜检查

正确答案：B。胎动计数

解析：胎动监测是评价胎儿宫内情况最简便有效的方法之一（B对）。经产妇一般在妊娠16周末自觉胎动，初产妇一般在妊娠20周末自觉胎动。正常胎动为3～5次/小时，胎动计数﹥30次/12小时为正常，﹤10次/2小时提示胎儿缺氧。催产素激惹试验（A错）主要用于预测胎儿宫内储备能力。尿雌三醇（C错）测定主要用于了解胎盘功能。胎儿电子监护（D错）能连续观察和记录胎心率的动态变化，评估胎儿宫内安危情况，但操作较复杂，不是最简便的方法。羊膜镜（E错）为有创检查方法，可危及母儿安全，临床上少用。